大量腹水时呼吸表现形式
A. 叹息式呼吸
B. 长吸式呼吸
C. 胸式呼吸
D. 腹式呼吸
E. 胸腹混合式呼吸

正确答案：C。胸式呼吸

解析：呼吸运动分为胸式呼吸和腹式呼吸。正常男性和儿童以腹式呼吸为主，女性以胸式呼吸为主。当腹膜炎、大量腹水，肝脾极度肿大，腹腔内巨大肿瘤及妊娠晚期时，膈肌向下运动受限，则腹式呼吸减弱，而代之以胸式呼吸（C对）。叹息样呼吸（P129）（A错）表现为在一般正常呼吸节律中插入1次深大呼吸并常伴有叹息声的呼吸，见于神经衰弱、精神紧张、抑郁症等。如果在脑桥的中上部横切脑干，呼吸运动将变慢变深；如果再切断双侧迷走神经，吸气运动便大大延长，仅偶尔为短暂的呼气运动所中断，这种形式的呼吸运动称为长吸式呼吸（B错）（P177）。